乳晕下脓肿，切开引流应
A. 沿乳晕边缘做弧形切口
B. 以乳头为中心循乳管方向做放射状切口
C. 沿乳房下缘做弧形切口
D. 对口引流
E. 洞式切口与中药线引流

正确答案：A。沿乳晕边缘做弧形切口

解析：乳房脓肿切开引流应注意以下几点：①为避免手术损伤乳管而形成乳瘘，切口应以乳头为中心循乳管方向做放射状切口（BE错），至乳晕处为止。深部或乳房后脓肿可沿乳房下缘做弧形切口（C错），经乳房后间隙引流，既有利于引流排脓，又可避免损伤乳管。乳晕下脓肿应沿乳晕边缘做弧形切口（A对）。②若炎症明显而波动感不明显者，应在压痛最明显处进行穿刺，及早发现深部脓肿。③切开后应以手指探入脓腔，轻轻分离多房脓肿的房间隔膜，以利引流。④为有利于引流通畅，可在探查脓腔时找到脓腔的最低部位，另做切口做对口引流（D错）。